制备（牙合）导板和固定装置属于
A. 术后正畸治疗
B. 追踪观察
C. 完成术前准备
D. 确认手术计划
E. 术前正畸治疗

正确答案：C。完成术前准备

解析：完成术前准备：除常规的全麻和输血准备外，应按设计的术式制备好（牙合）引导板和所需的骨块移动后的固定装置，并根据手术计划、预期效果及可能出现的问题，向病员做充分的说明。掌握“牙颌面畸形”知识点。